子宫内膜异位症痛经的特点是
A. 痛经发生于月经前期
B. 痛经发生于月经前，经期加重，经后缓解
C. 痛经与月经周期无关
D. 痛经经期较轻微，经后加重
E. 痛经多为原发性痛经

正确答案：B。痛经发生于月经前，经期加重，经后缓解

解析：子宫内膜异位症主要症状是痛经，特点为继发性痛经、进行性加剧。疼痛多位于下腹及腰骶部，可放射至阴道、会阴、肛门或大腿，可发生在经前及经期，亦可出现在经后，呈周期性。但也有表现为非周期性的慢性盆腔痛（B对）。